共同参与构成桡腕关节关节头的腕骨有
A. 钩骨、三角骨
B. 钩骨、手舟骨
C. 手舟骨、月骨、三角骨
D. 手舟骨、月骨、豌豆骨
E. 无

正确答案：C。手舟骨、月骨、三角骨

解析：桡腕关节由手的舟骨、月骨和三角骨（C对）的近侧关节面作为关节头，桡骨骨的腕关节面和尺骨头下方的关节盘作为关节窝而构成。